其盐酸盐在冷水中溶解度小的是
A. 小檗碱
B. 麻黄碱
C. 伪麻黄碱
D. 东莨菪碱
E. 山莨菪碱

正确答案：A。小檗碱

解析：本题考查的是小檗碱的溶解性。其盐酸盐在冷水中溶解度小的是小檗碱（A对）。小檗碱的溶解性：游离小檗碱能缓缓溶解于水中，易溶于热水或热乙醇，在冷乙醇中溶解度不大，难溶于苯、三氯甲烷、丙酮等有机溶剂。小檗碱盐酸盐在水中溶解度较小，为1∶500，较易溶于沸水，难溶于乙醇；而硫酸盐和磷酸盐在水中的溶解度较大，分别为1∶30和1∶15。麻黄碱（B错）与伪麻黄碱（C错）的分子较小，且属芳烃仲胺生物碱，其溶解性与一般的生物碱不完全相同。游离麻黄碱可溶于水，但伪麻黄碱在水中的溶解度较麻黄碱小。这是由于伪麻黄碱形成较稳定的分子内氢键的缘故。麻黄碱和伪麻黄碱也能溶于三氯甲烷、乙醚、苯及醇类溶剂。麻黄碱盐与伪麻黄碱盐的溶解性能也不完全相同，如草酸麻黄碱难溶于水，而草酸伪麻黄碱易溶于水；盐酸麻黄碱不溶于三氯甲烷，而盐酸伪麻黄碱可溶与三氯甲烷。东莨菪碱（D错）有较强的亲水性，可溶于水，易溶于乙醇、丙酮、乙醚、三氯甲烷等溶剂，难溶于苯、四氯化碳等强亲脂性溶剂。山莨菪碱（E错）由于多一个羟基，亲脂性较莨菪碱弱，能溶于水和乙醇。